提出纯技术模式、权威模式、契约模式这三种医患关系模式的是
A. 罗伯特-维奇
B. 布朗斯坦
C. 萨斯-荷伦德
D. 弗艾德
E. 迪肯

正确答案：A。罗伯特-维奇

解析：美国学者罗伯特-维奇提出三种医患关系模式：纯技术模式、权威模式、契约模式。掌握“医患沟通的理论、技术与其应用以及医患关系模式”知识点。